说明抗休克治疗时液体已补足的是
A. 尿量少，CVP很高
B. 尿量少，CVP较低
C. 尿量多，CVP很低
D. 尿量多，CVP正常
E. 尿量多，CVP偏高

正确答案：D。尿量多，CVP正常

解析：补充血容量是纠正休克引起的组织低灌注和缺氧的关键，而监测指标为尿量和中心静脉压等。尿量反映肾脏的灌注，尿量多说明肾灌注充足，说明机体血容量充足；CVP即中心静脉压，代表了右心房或者胸腔段腔静脉内压力变化，可反映全身血容量与右心功能之间的关系，中心静脉压正常表示血容量充足。综上，尿量多，CVP正常，说明液体量已补充足（D对）。尿量少，CVP很高提示可能出现急性肾衰竭（A错）。尿量少，CVP较低提示休克未纠正（B错）。尿量多，CVP很低可见于创伤危重病人复苏时使用高渗溶液者或涉及神经垂体的颅脑损伤出现尿崩者（C错）。尿量多，CVP偏高提示充血性心力衰竭可能（E错）。